下列各项，可见间歇热的是
A. 急性肾盂肾炎
B. 肺炎
C. 风湿热
D. 渗出性胸膜炎
E. 霍奇金病

正确答案：A。急性肾盂肾炎

解析：间歇热指体温骤升达高峰后持续数小时，又迅速降至正常水平，无热期可持续1天至数天，如此高热期与无热期反复交替出现，常见于疟疾、急性肾盂肾炎（A对）。肺炎（B错）表现为稽留热。风湿热（C错）表现为弛张热。渗出性胸膜炎（D错）表现为不规则热。霍奇金病（E错）表现为回归热。